下列哪项不是能促使医院感染患者易感性升高的因素
A. 年龄
B. 侵入性诊疗方法
C. 长期使用激素类药物
D. 医院消毒隔离和灭菌操作不严格
E. 长期应用抗生素

正确答案：D。医院消毒隔离和灭菌操作不严格